查阅药物的性状、药理作用、用法用量及注意事项等内容的常用文献是
A. 《英汉化学化工词汇》
B. 《英汉医学名词汇编》
C. 《中国药品通用名称》
D. 《中国药学年鉴》
E. 《新编药物学》

正确答案：E。《新编药物学》